既滋阴润肺，又养胃生津的药是
A. 大枣
B. 沙苑子
C. 骨碎补
D. 太子参
E. 玉竹

正确答案：E。玉竹

解析：本题考查的是玉竹的功效。既滋阴润肺，又养胃生津的药是玉竹（E对）。玉竹：【功效】滋阴润肺，生津养胃。大枣（A错）：【功效】补中益气，养血安神，缓和药性。沙苑子（B错）：【功效】补肾固精，养肝明目。骨碎补（C错）：【功效】补肾，活血，止痛，续伤。太子参（D错）：【功效】补气生津。